女，30岁。面部皮疹、发热1个月，水肿1周。查体：T37.8℃，BP160/100mmHg。颜面可见充血性皮疹，腹部移动性浊音（+），双下肢中度凹陷性水肿。血常规：Hb96g/L，WBC3.1×10⁹/L，Plt67×10⁹/L。尿沉渣镜检RBC满视野，WBC8~10/HP。尿蛋白定量4.2g/24h。肾功能正常，血C3下降。首先考虑的诊断是
A. 原发性小血管炎肾损害
B. 乙型肝炎病毒相关性肾炎
C. 狼疮肾炎
D. 过敏性紫癜性肾炎
E. 急性肾小球肾炎

正确答案：C。狼疮肾炎

解析：患者青年女性，为系统性红斑狼疮（SLE）常见发病年龄，面部充血性皮疹（SLE常见表现）、发热（全身症状）1个月，腹部移动性浊音（+）（SLE累及消化系统表现）；尿沉渣镜检RBC满视野，WBC8~10/HP。尿蛋白定量4.2g/24h，双下肢中度凹陷性水肿（SLE累及肾脏表现）；血常规：Hb96g/L（正常女性Hb＞110g/L），WBC3.1×10⁹/L（正常为4-10×10⁹/L），Plt67×10⁹/L（SLE累及血液系统表现）；患者出现多系统功能受损症状，根据临床表现、体征及已给检查，应考虑患者所患疾病为系统性红斑狼疮狼疮肾炎（C对）。余选项均不能导致多系统改变，与题目内容不符合（ABDE错）。